阻断H₂受体的抗消化性溃疡药是
A. 碳酸氢钠
B. 法莫替丁
C. 奥美拉唑
D. 枸橼酸铋钾
E. 拉贝拉唑

正确答案：B。法莫替丁

解析：本题考查法莫替丁。法莫替丁（B对）属于第三代H₂受体阻断剂，能够可逆性竞争壁细胞基底膜上的H₂受体，显著抑制胃酸分泌，主要用于胃及十二指肠溃疡、功能性消化不良、消化性溃疡并发出血等；碳酸氢钠（A错）属于抗酸剂；奥美拉唑（C错）和拉贝拉唑（雷贝拉唑）（E错）属于质子泵抑制剂；枸橼酸铋钾（D错）属于胃黏膜保护剂，与溃疡部位氨基酸及蛋白质络合凝结，保护溃疡表面免受食物、胃酸、胃蛋白酶的侵蚀。